30岁。已婚妇女，停经48天，剧烈腹痛2天，阴道不规则流血1天，今晨从阴道排出三角形模样组织，检查：贫血外貌，下腹部压痛，反跳痛明显。正确治疗措施应选择
A. 立即行刮宫术
B. 静脉滴注缩宫素
C. 肌注麦角新碱
D. 行剖腹探查术
E. 应用止血药

正确答案：D。行剖腹探查术

解析：已婚妇女停经48天（输卵管妊娠多有6～8周停经史），阴道流血和剧烈腹痛（典型症状为停经后腹痛与阴道流血），从阴道排出三角形膜样组织（阴道流血可伴有蜕膜管型或蜕膜碎片排出，是子宫蜕膜剥离所致），贫血外貌，下腹部压痛反跳痛明显（腹部检查：下腹有明显的压痛及反跳痛，尤以患侧为著，但腹肌紧张轻微），最可能的诊断为异位妊娠破裂腹腔内出血，应行剖腹探查术（D对），以达到止血和手术治疗的目的。立即行刮宫术（P50）（A错）适用于早期难免流产及不全流产，可清除宫腔内残留组织，也可用于功能失调性子宫出血，有助于诊断，并有迅即止血效果。静脉滴注缩宫素（P189）（B错）适用于协调性宫缩乏力时的催产和晚期难免流产时的引产。肌注麦角新碱（C错）用于流产后预防出血和治疗宫收缩无力或缩复不良导致的产后出血。应用止血药（E错）属于一般辅助治疗措施，对异位妊娠破裂出血效果不佳。